某单位会餐的100人中，有30人因食某一被弧菌污染的食物，于会餐后的3天内发生腹泻、腹痛。请问30%是
A. 发病率
B. 患病率
C. 罹患率
D. 感染率
E. 相对危险度

正确答案：C。罹患率

解析：本题考查罹患率。罹患率（C对ABDE错）表示某人群某病新病例发生频率，通常多指在某一局限范围，短时间内的发病频率。适用于局部地区疾病的爆发，食物中毒、传染病及职业中毒等爆发流行情况。